支原体感染可引起
A. 脑膜炎
B. 肠炎
C. 肺炎
D. 沙眼
E. 流感

正确答案：C。肺炎